高分化型黏液表皮样癌的细胞成分主要是
A. 肌上皮和黏液样组织为主
B. 中间细胞和表皮样细胞为主
C. 黏液细胞和中间细胞为主
D. 黏液细胞和表皮样细胞为主
E. 腺上皮细胞和肌上皮细胞为主

正确答案：D。黏液细胞和表皮样细胞为主

解析：黏液表皮样癌根据黏液细胞、中间细胞和表皮样细胞成分的比例及细胞分化程度分为3种类型：高分化（低度恶性）型：黏液细胞和表皮样细胞为主，占肿瘤细胞的50%以上，中间细胞较少。②低分化（高度恶性）型：构成细胞主要是中间细胞和表皮样细胞，黏液细胞较少，低于10%，散在于表皮样细胞之间。肿瘤细胞异形性及核分裂象明显。③中分化（中度恶性）型：介于上述两型之间。掌握“黏液表皮样癌”知识点。